口腔的表面解剖标志不包括
A. 口腔前庭沟
B. 上、下唇及颊系带
C. 翼下颌韧带
D. 腮腺导管口
E. 磨牙后区

正确答案：C。翼下颌韧带

解析：口腔的表面解剖标志：有临床意义的有口腔前庭沟（为唇、颊黏膜移行于牙槽黏膜的沟槽）、上、下唇系带、颊系带、腮腺管乳头、磨牙后区、翼下颌皱襞、颊垫尖等。掌握“口腔境界及唇、颊的局部解剖”知识点。